剑突下出现心脏搏动，吸气时加强，提示
A. 左心房扩大
B. 右心房扩大
C. 左心室扩大
D. 右心室扩大
E. 脉压增大

正确答案：D。右心室扩大

解析：剑突下出现心脏搏动，吸气时加强，提示右心室扩大（D对）。左心房增大时，心尖搏动向左下移位，胸骨左缘第3肋间心浊音界增大，心电图呈“二尖瓣P波”，X线左右前斜位吞钡检查时可见食管向后移位（A错）。右心房显著增大时，右心浊音界增大，心电图见“肺性P波”，X线见右心缘几乎被右心房占据（B错）。左心室增大时，心尖搏动向左下方移位，触诊心尖有抬举性冲动，叩诊心界向左下扩大。心电图示电轴左偏及左心室肥厚（C错）。周围血管征是指由于脉压增大而导致周围动脉和毛细血管搏动增强的一组体征（E错）。